参与构成视觉细胞内感光物质的维生素是
A. 维生素D
B. 维生素A
C. 维生素B2
D. 维生素B
E. 维生素C

正确答案：B。维生素A

解析：参与构成视觉细胞内感光物质的维生素是维生素A（B对），维生素A的活性形式视黄醇、视黄醛参与构成了视循环，维持正常视觉功能。维生素D（A错）参与血钙调节和组织细胞分化（P94）。维生素B₂（C错）的活性形式FMN和FAD是体内氧化还原酶的辅基（P98）。维生素B（D错）属于水溶性维生素，包括维生素B₁、维生素B₂、维生素PP、维生素B₆、生物素、泛酸和叶酸，具有不同的结构和功能（P97）。维生素C（E错）是机体一些羟化酶的辅酶又是强抗氧化剂，也可直接参与体内氧化反应，具有增强机体免疫力的作用（P101-P102）。